妊娠病的辨证，首先要辨
A. 寒热
B. 外感或内伤
C. 虚实
D. 母病或胎病
E. 脏病或腑病

正确答案：D。母病或胎病

解析：妊娠病的辨证，首先要分辨是胎病及母还是母病动胎（D对）；其次要辨明胎儿情况，以明确可安胎还是下胎益母；再者根据妊娠病不同临床主症的特点，结合全身兼症、舌脉征象和体质等因素进行辨证。